影响生物碱碱性强弱的因素有
A. 氮原子的杂化方式
B. 诱导效应
C. 共轭效应
D. 空间效应
E. 氢键效应

正确答案：A、B、C、D、E。氮原子的杂化方式；诱导效应；共轭效应；空间效应；氢键效应

解析：本题考查的是生物碱碱性影响因素。氮原子的杂化方式（A对）、诱导效应（B对）、共轭效应（C对）、空间效应（D对）与氢键效应（E对）。生物碱碱性强弱与分子结构的关系：（1）氮原子的杂化方式。（2）电性效应：①诱导效应；②共轭效应：苯胺型、酰胺型。（3）空间效应。（4）氢键效应。